女，28岁，近4个月来全口牙龈逐渐肿大，刷牙时牙龈易出血，偶有牙龈自动出血史。若患者妊娠6个月，诊断为妊娠期龈炎，临床上最可能表现为牙龈色鲜红、光亮。若患者未妊娠，怀疑为白血病在口腔的表现，确诊的方法为
A. 活检
B. 脱落细胞涂片
C. 白细胞吞噬功能
D. 白细胞趋化功能
E. 查血象

正确答案：E。查血象

解析：本题考查白血病的牙龈病损的诊断。由于白血病患者血液中有不成熟血细胞的数量和形态异常，故可查血象（E对）来确诊。活检（A错）是从患者体内切取、钳取或穿刺等取出病变组织，进行病理学检查的技术，而白血病是恶性血液病，不能通过此种方式确诊。脱落细胞涂片（B错）对白细胞形态无法鉴定，故不能确诊白血病。白细胞吞噬能力（C错）是细胞免疫体外实验法，而非白血病的诊断方法。白细胞趋化功能（D错）是指白细胞向着化学刺激物作定向移动的作用，不能反应血细胞的数目形态。